关于健康危险度评价的描述，不正确的是
A. 以可接受的危险水平代替安全性
B. 健康危险度评价需要定量阐明危害健康的程度
C. 把环境污染对人体健康的影响定量化
D. 健康危险度的评价可用于环境质量评价
E. 健康危险度评价的研究对象是一般普通人群

正确答案：D。健康危险度的评价可用于环境质量评价

解析：本题考查健康危险度评价。健康危险度评价是按一定的准则，应用毒理学研究和流行病学调查等的资料，系统科学地表征有害环境因素暴露对人类和生态的潜在损害作用，并对产生这种损害作用证据的强度或充分性进行评定，对危险性评估相关的不确定性进行评价。其研究对象是一般普通人群（E对）。其主要特点是：1.健康保护观念的转变。安全是相对的，在任何情况下要绝对的安全是不可能的。因为不可能将有害健康的污染物完全清除，只能逐步控制污染，使之对健康的影响处于一般人可接受的危险水平（A对）。2.把环境污染对人体健康的影响定量化（C对）。环境污染对人体健康的影响或危害不仅是“有”或“无”的判别标准，而是定量地阐明危害健康的程度（B对）。健康危险度评价主要应用在以下几个方面：1.预测预报在特定环境因素暴露条件下，暴露人群终生发病或死亡的概率；2.对各种有害化学物或其他因素的危险度进行比较评价，排列治理次序，用于新化学物的筛选，并从公共卫生、经济、社会、政治等方面进行论证及各种经济效益、利弊分析，为环境管理决策提供科学依据；3.有害物质及致癌物环境卫生标准的研制，提出环境中有害化学物及致癌物的可接受浓度，同时研制有关法规、管理条例，为卫生监督工作提供重要依据（D错，为本题正确答案）。